可导致血压升高的药物有
A. 地塞米松
B. 麻黄碱
C. 多沙唑嗪
D. 垂体后叶素
E. 重组人红细胞生成素

正确答案：A、B、D、E。地塞米松；麻黄碱；垂体后叶素；重组人红细胞生成素

解析：本题考查导致药源性高血压的药物。导致药源性高血压的药物：（1）麻醉药（普鲁卡因、利多卡因、丙泊酚等）；（2）阿片受体拮抗药（纳洛酮）；（3）酒精、咖啡因、中枢神经系统兴奋药（哌甲酯、苯丙胺）；（4）含钠药物；（5）非甾体抗炎药；（6）重组人红细胞生成素（E对）；（7）肾上腺皮质激素（如地塞米松）（A对）；（8）中药甘草有效成分为甘草酸；（9）抗肿瘤药物；（10）曲马多、芬太尼、萘甲唑啉、麻黄碱（B对）、伪麻黄碱、去氧肾上腺素、垂体后叶素（D对）、麦角碱、麦角新碱；（11）单胺氧化酶抑制剂；（12）雌激素类避孕药。多沙唑嗪（C错）属于α受体阻断剂，属于降压药。